血管紧张素酶抑制剂治疗心衰和抗高血压的作用机制不包括
A. 抑制激肽酶，增加缓激肽的降解
B. 抑制局部组织中的血管紧张素转换酶
C. 抑制激肽酶，减少缓激肽的降解
D. 抑制血管的构型重建
E. 抑制心室的构型重建

正确答案：A。抑制激肽酶，增加缓激肽的降解

解析：血管紧张素酶抑制剂通过抑制局部组织中的血管紧张素转换酶（ACE）（B对）减少血管紧张素Ⅱ（ATⅡ）生成而抑制RAAS，同时抑制激肽酶，减少缓激肽的降解（C对）（A错，为本题正确答案），使缓激肽介导的前列腺素生成增加，发挥扩血管作用，从而降低血压；也可通过降低心衰患者神经-体液代偿机制的不利影响，抑制血管和心室的构型重建（DE对），延缓心衰进程，降低心力衰竭患者的死亡率。